根据“子母补泻法”，肾经实证应取
A. 阴谷
B. 复溜
C. 然谷
D. 太溪
E. 涌泉

正确答案：E。涌泉

解析：根据选项可知属于本经子母补泻法：肾经的实证应“泻其子”，肾在五行中属“水”，因“水生木”，“木”为“水”之子，按照阴经第十版针灸学（阳井金，阴井木）五输穴五行属性第十版针灸学（木火土金水）的顺序，可选本经五输穴中属“木”的井穴涌泉（E对），这是本经的子母补泻法。阴谷五行属性属水（A错）；复溜五行属性属金（B错）；然谷五行属性属火（C错）；太溪五行属性属土（D错）。